属于细辛主要不良反应表现的是
A. 面神经损伤
B. 认知功能障碍
C. 呼吸中枢麻痹
D. 溶血性贫血
E. 睾丸萎缩

正确答案：C。呼吸中枢麻痹

解析：本题考查细辛的不良反应。属于白矾的不良反应为呼吸中枢完全麻痹（C对）。细辛不良反应表现：细辛中的挥发油直接作用于中枢神经系统，最终可因呼吸中枢完全麻痹而致死。细辛的急性毒性对小鼠肺、肝、肾等重要脏器均有明显损害，其中对肺脏的病理损害最为严重。蜈蚣不良反应表现：①消化道症状：恶心、呕吐，腹痛、腹泻，十二指肠溃疡，黄疸、急性肝损害等。②循环系统：胸闷、气短，心律失常，血压下降等。③泌尿系统：急性肾功能损害，尿量减少等。④血液系统：溶血性贫血，酱油尿、黑便等。⑤神经系统：抽搐、面神经损害（A错）等。⑥过敏反应：过敏性皮疹、口唇肿胀、鼻黏性分泌物大量流出、呼吸困难等，严重者可致过敏性休克。白矶不良反应表现：（1）急性中毒：大剂量内服可引起口腔、喉头烧伤，呕吐腹泻，虚脱，甚至死亡。曾有文献报道1例重度硫酸铝钾（白矾中的主要成分）中毒，患者表现为心率增快、心电图T波高尖（高钾血症导致），血压降低，上腹部烧灼样痛，尿少及严重腹泻。（2）慢性中毒：慢性中毒主要为白矾中的铝离子长期摄入导致的蓄积反应，表现如下。①神经毒性：阿尔茨海默病、痴呆和认知功能障碍（B错）。②骨骼：骨软化和骨营养不良。③肝肾功能损伤：动物试验证实铝蓄积可导致肝肾功能损伤。④血液系统：非缺铁性的小细胞低色素性贫血等。胆矾不良反应表现：①消化系统：流涎、恶心、呕吐、腹痛、腹泻、呕血、便血等，口涎、呕吐物、粪便多呈蓝绿色，口中有特殊金属味；黄疸、中毒性肝炎等症状。②血液系统：溶血性贫血（D错）。③泌尿系统：蛋白尿、血尿、少尿、无尿、氮质血症、急性肾功能衰竭或尿毒症等。④循环系统：血管麻痹、血压下降。铜离子对心脏损害可引起中毒性心肌炎，表现为心动过速、心律失常及心力衰竭。⑤神经系统：头痛头晕、全身乏力，严重者出现脑水肿、痉挛、神经麻痹、谵妄、意识障碍等中毒性脑炎症状。雷公藤不良反应表现：①消化系统：腹痛、腹泻，恶心、呕吐，食欲不振，肝损害，少数可致伪膜性肠炎，严重者可致消化道出血。②血液系统：血小板、白细胞、血红蛋白减少，严重者可发生急性粒细胞减少、再生障碍性贫血等。③生殖系统：对男性患者雷公藤可抑制精细胞中酶的活性，导致精子产生和成熟发生障碍，表现为精子数量显著减少，长期用药还会导致性欲减退、睾丸萎缩（E错）；对女性患者雷公藤可抑制其卵巢功能，表现为月经紊乱、经量减少、卵巢早衰。